拔除一颗乳磨牙。其余牙均正常。其dfms为
A. 1
B. 2
C. 3
D. 4
E. 5

正确答案：E。5

解析：本题考查评价龋病的常用指数。拔除一颗乳磨牙。其余牙均正常。其dfms为5（E对）。乳牙龋失补指数用小写英文字母表示，乳牙龋失补牙数即dmft，乳牙龋失补牙面数即dmfs。龋失一颗前牙为4个面，后牙5个面。